病毒引起白细胞升高的疾病是
A. 乙型脑炎病毒
B. 肺结核
C. 败血症
D. 风湿热
E. 细菌性痢疾

正确答案：A。乙型脑炎病毒

解析：白细胞升高，最常见的是细菌感染，病毒感染一般不会引起白细胞升高，立克次体、螺旋体、真菌感染白细胞数目一般正常或稍增高。引起白细胞升高的病毒有乙脑（A对）、狂犬病毒、汉坦病毒引起的出血热和EB病毒。